青霉素中聚合物检查应采用的方法是
A. 红外分光光度法
B. 紫外-可见分光光度法
C. 分子排阻色谱法
D. 高效液相色谱法
E. 抗生素微生物检定法

正确答案：C。分子排阻色谱法

解析：本题考查青霉素的有关物质与检查。《中国药典》规定需检查聚合物，聚合物的检查采用分子排阻色谱法（C对）。